热源集中，具有强辐射热源的高温作业，应采取的通风降温措施为
A. 全面自然通风
B. 局部抽出式机械通风
C. 喷雾风扇
D. 有组织的自然通风
E. 全面机械通风

正确答案：C。喷雾风扇